健康危险因素评价的主要目的在于
A. 确定疾病的生物学病因
B. 对健康危险因素做出定性分析
C. 促进入们改变不良行为
D. 控制传染病的传播
E. 诊治疾病

正确答案：C。促进入们改变不良行为